重度锰中毒患者主要表现
A. 腹绞痛
B. 肾功能损害
C. 锥体外系神经障碍
D. 血液系统损害
E. 慢性肝病

正确答案：C。锥体外系神经障碍